当出现烟雾事件时，下述措施哪一项是错误的
A. 劝告居民尽量在室内活动，关闭门窗
B. 外出戴上口罩
C. 患有呼吸道及心血管慢性疾病者尽可能吸氧
D. 减少或停止污染源的废气排放
E. 无慢性疾病者可进行适当的室外体育活动

正确答案：E。无慢性疾病者可进行适当的室外体育活动

解析：本题考查烟雾事件的应对措施。烟雾事件是指大气中烟尘、硫酸盐等有害物质的浓度超过国家规定的标准，对人体健康有害。因此，在烟雾事件发生时，应采取有效的措施来保护人们的健康。本题A、B、C、D都是正确的措施。而无慢性疾病者可进行适当的室外体育活动（E错，为本题正确答案）是错误的措施，因为烟雾事件发生时，室外空气中有害物质的浓度超过国家规定的标准，对人体健康有害，无论是否患有慢性疾病的人，都不应该进行室外体育活动，以免加重对人体健康的危害。